亚临床状态变化也就是
A. 正常调节变化
B. 二蓄积阶段的变化
C. 代偿阶段变化
D. 失代偿阶段变化
E. 耐受阶段变化

正确答案：C。代偿阶段变化

解析：本题考查亚临床状态变化。亚临床变化是指人体接触环境中的生物性的、化学性的、物理性的致病因素后，发生代谢或功能上某种程度的变化，但无明显的临床症状和体征。因此，亚临床状态变化也就是代偿阶段变化（C对ABDE错）。